硼砂外用的功效是
A. 清肺化痰
B. 清热解毒
C. 攻毒杀虫
D. 解毒止痒
E. 蚀疮去腐

正确答案：B。清热解毒

解析：硼砂的功效是外用清热解毒（B对），内服清肺化痰（A错）。砒石外用的功效是攻毒杀虫（C错），蚀疮去腐（E错）。硫黄外用的功效是解毒止痒（D错），杀虫。